吞咽梗阻，胸膈疼痛，食不得下，甚至水饮难下，食入即吐，面色晦滞，形体消瘦，大便坚如羊屎，舌红少津，脉细涩。选择其治法为
A. 养阴润燥，降气消导
B. 益气养阴，行气化痰
C. 润燥行瘀，化痰散结
D. 滋阴养血，破结行瘀
E. 滋阴养血，散结化痰

正确答案：D。滋阴养血，破结行瘀

解析：瘀血内结，阻于食道，因而痈有定所，吞咽梗阻，胸膈疼痛，食不得下，甚至水饮难下，食入即吐；长期饮食不入，化源枯涸，故见面色晦滞，形体消瘦；由于病久，阴血内伤，肠道失于濡润，故见大便坚如羊屎；舌红少津，脉细涩，均为噎膈痰瘀内结之象，治法为滋阴养血，破结行瘀（D对）。养阴润燥，降气消导（A错）用于治疗热结津伤证。益气养阴，行气化痰（B错）用于治疗气虚痰凝证。润燥行瘀，化痰散结（C错）用于治疗痰瘀伤阴证。滋阴养血，散结化痰（E错）用于治疗阴亏血少证。